患者，男，45岁。脘腹胀痛，呕吐，停止排便排气60小时。检查：神情淡漠，末梢循环差，腹胀如鼓，全腹压痛、反跳痛及肌紧张，肠鸣音微弱，舌红绛苔黄腻，脉沉细数。应首先考虑的是
A. 肠梗阻瘀结证
B. 肠梗阻热结证
C. 肠梗阻痞结证
D. 阑尾炎瘀滞证
E. 阑尾炎湿热证

正确答案：B。肠梗阻热结证

解析：患者脘腹胀痛，呕吐，停止排便排气，神情淡漠，末梢循环差，腹胀如鼓，全腹压痛反跳痛及肌紧张，肠鸣音微弱，舌红绛苔黄腻，脉沉细数应首先考虑的是肠梗阻热结证。由于外邪侵入肠中，导致经络阻塞，气血凝滞，瘀积日久，化热化火，热邪郁闭肠腑，或肠腑瘀久化热，伤阴损阳而致（B对）。肠梗阻瘀结证症候为腹痛阵作、胀满拒按，恶心呕吐，无排气排便，或大便少许干燥；小便短赤，舌红少津，脉弦或涩（A错）。肠梗阻痞结证临床表现腹胀腹痛较轻，无膜刺激征，一般情况好；舌质淡，舌苔薄，脉弦（C错）。阑尾炎瘀滞证转移性右下腹痛，呈持续性、进行性加剧，右下腹局限性压痛或拒按；伴恶心纳差，可有轻度发热；苔白腻，脉弦滑或弦紧（D错）。阑尾炎湿热证腹痛加剧，右下腹或全腹压痛、反跳痛，腹皮挛急，右下腹可摸及包块；壮热，恶心纳差，便秘或腹泻；舌红苔黄腻，脉弦数或滑数（E错）。